推论病因与疾病因果关联的标准错误的是
A. 关联的强度
B. 关联的时间性
C. 关联的特异性
D. 关联的可重复性
E. 关联的地区性

正确答案：E。关联的地区性

解析：判断病因与疾病因果关联的判断标准为：1、关联的强度（A对）；2、关联的重复性（D对）；3、关联的特异性（C对）；4、关联的时间性（B对）；5、剂量-反应关系；6、关联的合理性；7、实验证据；8、相似性。（1）联系强度常以相对危险度（RR）或比值比（OR）来表示。相对危险度越大，该联系有因果关系的可能性亦越大。（2）联系的一致性某种疾病在人群、时间、空间的分布与研究因素在三者中的分布相一致，提示两者可能有因果联系。（3）联系的时间顺序从时间顺序来说总是“因先于果”不能逆转，此为因果联系中的一个必要条件。（4）联系特异性某种疾病仅与某种因素有联系而与其他因素无关，这种联系是特异的。在判断标准中不包括关联的地区性（E错，为本题正确选项）。